26岁初孕妇。妊娠38周，主诉肋下有块状物。腹部检查：子宫呈纵椭圆形，胎先露部较软且不规则，胎心在脐上偏左，本例应诊断为
A. 枕先露
B. 臀先露
C. 面先露
D. 肩先露
E. 复合先露

正确答案：B。臀先露

解析：青年初孕妇，妊娠38周，肋下有块状物，子宫呈纵椭圆形，胎先露部较软且不规则，胎心在脐上偏左，应诊断为臀先露（B对）。若枕先露（P145）（A错），则先露部硬而圆且有浮球感。面先露（P202）（C错）颏后位时，在胎背侧触到极度仰伸的枕骨隆突，若面先露颏前位时，胎体伸直使胎儿胸部更贴近孕妇腹前壁，使胎儿肢体侧的下腹部胎心听诊更清晰。肩先露（P206）（D错）时子宫呈横椭圆形，子宫横径较正常妊娠宽，在母体腹部一侧触及胎头，另侧触及胎臀。复合先露（P207）（E错）常因产程进展缓慢行阴道检查时发现，以胎头与手复合先露最为常见。